突发公共卫生事件应急工作，应当遵循的方针是
A. 预防为主，常备不懈
B. 统一领导，分级负责
C. 预防为主，常备不懈，反应及时，措施果断，依靠科学
D. 统一领导，分级负责，依靠科学，加强合作
E. 统一领导，分级负责，反应及时，措施果断，依靠科学，加强合作

正确答案：A。预防为主，常备不懈